关于超敏反应正确的理解是
A. 不出现组织细胞损伤
B. 机体反应性处于低状态
C. 不是特异性的
D. 属于正常免疫应答
E. 属于异常免疫应答

正确答案：E。属于异常免疫应答

解析：机体的适应性免疫应答可提供针对细菌、病毒、寄生虫以及真菌所感染的特异性防御（C错），特别是，适应性免疫应答具有免疫记忆性，针对相同或相似的外源性微生物或毒素的再次刺激，能够产生快速的应答反应。然而，由于某些特定原因，使机体产生的免疫应答反应过度（B错）或不适当，出现组织细胞损伤（A错）的异常免疫应答（E对D错），通常称之为超敏反应。